男性，5岁。上前牙唇面有弧形带状发黑3个月。无自发痛症状。口腔检查：左右上1唇侧新生线处有浅龋，损害呈新月形。叩诊（-），探诊（-）。最可能的诊断是
A. 急性龋
B. 慢性龋
C. 继发龋
D. 线性牙釉质龋
E. 根面龋

正确答案：D。线性牙釉质龋

解析：本题考查线性牙釉质龋。男性，5岁。上前牙唇面有弧形带状发黑3个月。无自发痛症状。口腔检查：左右上1唇侧新生线处有浅龋，损害呈新月形。叩诊（-），探诊（-）。最可能的诊断是线性牙釉质龋（D对）。线形釉质龋主要发生于乳上颌前牙唇面的新生线处，表现为乳上颌前牙釉质表面的新生带部位产生新月形的龋损。急性龋病变组织颜色较浅，呈浅棕色（A错）。慢性龋病程进展慢，病变组织干燥，无新月形损害特征（B错）。龋病治疗后，由于充填物边缘或窝洞周围牙体组织破裂，形成菌斑滞留区，或修复材料与牙体组织不密合，留有小的缝隙，这些都有可能成为致病条件，产生龋病，称继发龋（C错）。根面龋为发生在根部牙骨质的龋病损害，主要发生于牙龈退缩、根面外露的老年人牙列（E错）。